躯干和四肢本体感觉传导通路中第2级神经元的节后神经纤维
A. 交叉前在同侧上行1-2个节段
B. 两侧交叉后上行
C. 直接交叉然后在对侧上行
D. 不交叉直接在同侧上行
E. 无

正确答案：C。直接交叉然后在对侧上行

解析：躯干和四肢本体感觉传导通路中第2级神经元的胞体在薄、楔束核内，在中线上与对侧的交叉后，节后神经纤维直接交叉然后在对侧上行（C对）。